1周内，脑力工作能力可能出现终末激发会在
A. 星期一
B. 星期二
C. 星期三
D. 星期四
E. 星期五

正确答案：E。星期五